下列除哪项外均主实证
A. 弦
B. 濡
C. 滑
D. 紧
E. 长

正确答案：B。濡

解析：濡脉是指位浮、形细、势软的脉象，多见于崩中漏下、失精、泄泻、自汗喘息等病证所致的精血、阳气亏虚之证（B错，为本题正确答案）。弦脉是指端直以长，如按琴弦的脉象，在肝胆病、疼痛、痰饮等，或胃气衰败中可见（A对）。滑脉是指往来流利，应指圆滑，如盘走珠的脉象，多见于痰湿、食积和实热等病证（C对）。紧脉是指脉来绷急弹指，状如牵绳转索的脉象，多见于实寒证、疼痛、食积（D对）。长脉是指脉搏的搏动超过寸、关、尺三部，首尾端直，脉象过长，常见于阳证、热证、实证，亦可见于平常人（E对）。